别嘌醇临床用于治疗
A. 高热
B. 痛风
C. 抑郁症
D. 躁狂症
E. 精神分裂症

正确答案：B。痛风

解析：本题考查别嘌醇的临床应用。别嘌醇临床用于治疗痛风（B对）。别嘌醇适应证：①原发性和继发性高尿酸血症，尤其是尿酸生成过多而引起的高尿酸血症；②反复发作或慢性痛风者；③痛风石；④尿酸性肾结石和（或）尿酸性肾病；⑤有肾功能不全的高尿酸血症。高热（A错）使用解热镇痛药，常用的有阿司匹林、对乙酰氨基酚、布洛芬等。抑郁症（C错）使用抗抑郁药，常用的有氟西汀、帕罗西汀、文拉法辛等。躁狂症（D错）使用抗躁狂药，常用的有碳酸锂。精神分裂症（E错）用抗精神病药，常用的有氯丙嗪、氯氮平、氟哌啶醇等。